腓总神经麻痹可出现的是
A. 剪刀步态
B. 醉酒步态
C. 慌张步态
D. 跨阈步态
E. 蹒跚步态

正确答案：D。跨阈步态

解析：腓总神经麻痹可出现的是跨阈步态（D对）。剪刀步态见于脑性瘫痪（A错）。醉酒步态见于小脑疾患、酒精中毒或巴比妥中毒（B错）。慌张步态见于帕金森病（C错）。蹒跚步态见于小脑共济失调（E错）。